下列哪一种是被动免疫制品
A. 抗狂犬病血清
B. 百日咳疫苗
C. 卡介苗
D. 破伤风类毒素
E. 流感疫苗

正确答案：A。抗狂犬病血清